以下方法所鉴别的药物是，取供试品水溶液，加碘试液后所显棕黄色，在5分钟内消失
A. 布洛芬
B. 盐酸普鲁卡因
C. 苯巴比妥
D. 司可巴比妥钠
E. 硫喷妥钠

正确答案：D。司可巴比妥钠